咳血方的功用是
A. 清热解毒、凉血散瘀
B. 凉血止血、利水通淋
C. 清肝宁肺、凉血止血
D. 清热泻火、利水通淋
E. 清热凉血、活血散瘀

正确答案：C。清肝宁肺、凉血止血

解析：咳血方中青黛咸寒，清肝泻火而凉血止血；山栀子苦寒，清热凉血，泻火除烦，炒黑可入血分而止血。瓜蒌仁清热化痰、润肺止咳；海粉清肺降火，软坚化痰。诃子苦涩平，生用清降敛肺，化痰止咳。诸药合用，共奏清肝宁肺之功，使木不刑金，肺复宣降，痰化咳平，其血自止（C对）。